动脉瘤最典型的临床表现是
A. 压迫症状
B. 搏动性肿块
C. 肢体远端肿块
D. 破裂出血
E. 体积增大伴疼痛感染

正确答案：B。搏动性肿块

解析：动脉瘤指动脉发生的局限性异常扩张，其最典型的临床表现为搏动性肿块（B对）和杂音。肿块表面光滑，触诊时具有膨胀性而非传导性搏动，且与心脏搏动一致，可伴有震颤和收缩期杂音。动脉瘤的其他临床表现还包括：①压迫症状（A错）；②远端肢体、器官缺血；③瘤体破裂出血（D错）；④感染性动脉瘤可有局部疼痛、周围组织红肿（E错）。